关于子宫，正确的是
A. 成年的子宫长7～8cm，宽4～5cm，厚4～5cm
B. 子宫体与子宫颈的比例，成年人为1：2
C. 子宫体与子宫颈之间形成最狭窄的部分为子宫峡部
D. 子宫峡部的上端是组织学内口
E. 经产妇的子宫颈外口是圆形

正确答案：C。子宫体与子宫颈之间形成最狭窄的部分为子宫峡部

解析：子宫体与子宫颈之间形成最狭窄的部分为子宫峡部（C对）。成年的子宫长7～8cm，宽4～5cm，厚2～3cm（A错）。子宫体与子宫颈的比例在青春期前为1：2（B错）。子宫峡部上端因解剖上狭窄，称为解剖学内口；其下端因在此处子宫内膜转变为子宫颈黏膜，称为组织学内口（D错）。未产妇的子宫颈外口是圆形（E错），已产妇受分娩影响形成横裂，将子宫颈分为前唇和后唇。